以下关于寿命表的说法，错误的是
A. 预期寿命可能随着年龄的增加而增加
B. 可用校正婴儿死亡率作为0岁组死亡概率的估计值
C. X岁尚存者在今后n年内的生存概率为npₓ＝1－nqₓ
D. 两地平均寿命的比较应该考虑人口构成不同的问题

正确答案：A。预期寿命可能随着年龄的增加而增加

解析：本题考查寿命表的相关内容。预期寿命不会随着年龄的增加而增加（A错，为本题正确答案）。两地平均寿命的比较不仅要考虑年龄组死亡率的高低，还要考虑人口的年龄结构（D对）。可用校正婴儿死亡率作为0岁组死亡概率的估计值（B对）。X岁尚存者在今后n年内的生存概率为npₓ＝1－nqₓ（C对）。